新生儿溶血病如需要换血疗法，经审核和患儿家属或监护人同意后，换血工作应由谁来实施
A. 上级医师实施
B. 经治医师实施
C. 输血科人员实施
D. 经治医师和输血科人员共同实施
E. 上级医师和输血科人员共同实施

正确答案：D。经治医师和输血科人员共同实施

解析：新生儿溶血病如需要换血疗法，经审核和患儿家属或监护人同意后，换血工作应由经治医师和输血科人员共同实施。掌握“医疗机构临床用血管理、及法律责任”知识点。